梅毒的病原体为
A. 苍白密螺旋体
B. 梭状杆菌和螺旋体
C. 白色念珠菌
D. 单纯疱疹病毒
E. 人类免疫类药物缺陷病毒

正确答案：A。苍白密螺旋体

解析：梅毒是由苍白螺旋体感染人体而发生的常见性传播疾病，已经问世数百年了，目前在世界范围均有分布，是十分重要的性传播疾病；可以分为先天梅毒、后天（获得性）梅毒等。掌握“梅毒的口腔表征”知识点。